不用于治疗风湿性关节炎的药物是
A. 阿司匹林
B. 对乙酰氨基酚
C. 羟基保泰松
D. 吲哚美辛
E. 舒林酸

正确答案：B。对乙酰氨基酚

解析：对乙酰氨基酚为乙酰苯胺类解热镇痛药，其解热作用与阿司匹林相似，而镇痛作用较弱。适用于缓解轻度至中度疼痛，如感冒引起的发热、头痛、关节痛、神经痛以及偏头痛、痛经等。对乙酰氨基酚因仅能缓解症状，消炎作用极微，且不能消除关节炎引起的红、肿、活动障碍，故不能用以代替阿司匹林或其他非甾体抗炎药治疗各种类型关节炎。掌握“对乙酰氨基酚、布洛芬、塞来昔布”知识点。